桃仁具有的作用是
A. 扩张冠脉
B. 止血
C. 润肠缓泻
D. 抑制免疫
E. 平喘

正确答案：C、E。润肠缓泻；平喘

解析：本题考查的是桃仁的功效。桃仁具有的作用是润肠通便（C对）与平喘（E对）。桃仁：【功效】活血祛瘀，润肠通便，止咳平喘。延胡索的药理作用：（1）镇痛。（2）镇静、催眠。（3）抗心肌缺血：延胡索总碱、去氢延胡索甲素、延胡索乙素可明显扩张冠脉血管（A错）。（4）抗脑缺血。（5）抗血栓。五灵脂：【功效】活血止痛，化瘀止血（B错），解蛇虫毒。川乌的药理作用：川乌具有镇痛、抗炎、免疫抑制（D错）、降血压及强心作用。